早期梅毒首选的治疗药物是
A. 阿昔洛韦
B. 苄星青霉素
C. 庆大霉素
D. 左氧氟沙星
E. 头孢曲松钠

正确答案：B。苄星青霉素

解析：早期梅毒首选的治疗药物是苄星青霉素（B对），孕期淋病首选的治疗药物是头孢曲松钠（E错）。